（牙合）支托具有以下作用，除了
A. 支持、传导（牙合）力
B. 作间接固位体
C. 恢复垂直距离
D. 防止食物嵌塞
E. 恢复咬合接触

正确答案：C。恢复垂直距离

解析：（牙合）支托：是卡环伸向基牙（牙合）面而产生支持作用的部分，防止义齿龈向移位，可保持卡环在基牙上的位置。如果余留牙间有间隙，（牙合）支托安放其间可以防止食物嵌塞。如果基牙倾斜移位，与对颌牙接触不良或无（牙合）接触，还可加（牙合）支托以恢复咬合关系。不具有恢复垂直距离的作用。掌握“局部义齿固位体”知识点。